对于B类型的预防性树脂充填，应该使用的修复材料为
A. 不含填料的封闭剂
B. 流动树脂
C. 复合树脂材料
D. 玻璃离子
E. 氧化锌丁香油

正确答案：B。流动树脂

解析：类型B预防性树脂充填：用小号或中号圆钻去除龋损组织，洞深基本在牙釉质内，通常用流动树脂材料充填。掌握“预防性树脂充填”知识点。